米帕明（丙米嗪）抗抑郁症的机制是
A. 促进脑内NA和5-HT释放
B. 抑制脑内NA和5-HT释放
C. 促进脑内NA和5-HT再摄取
D. 抑制脑内NA和5-HT再摄取
E. 激活脑内D2受体

正确答案：D。抑制脑内NA和5-HT再摄取

解析：丙咪嗪（米帕明）抗抑郁作用的主要机制是阻断NA、5-HT在神经末梢的再摄取，从而使突触间隙的递质浓度增高，促进突触传递功能。掌握“丙米嗪、碳酸锂、氟西汀”知识点。